患者呕吐吞酸，嗳气频繁，胸胁闷痛，脉弦。治疗应选用
A. 干姜
B. 高良姜
C. 吴茱萸
D. 丁香
E. 小茴香

正确答案：C。吴茱萸

解析：呕吐吞酸，治以降逆止呕，嗳气频繁，治以疏肝解郁，胸胁闷痛，脉弦，治以制酸止痛。吴茱萸主入肝经，能疏肝气之郁滞，辛散苦泄，能降逆止呕，制酸止痛，具有散寒止痛，降逆止呕，助阳止泻的功效（C对）。干姜具有温中散寒，回阳通脉，温肺化饮的功效，为温暖中焦之主药，没有疏肝解郁的功效（A错）。高良姜具有散寒止痛，温中止呕的功效，为温脾胃之药，没有疏肝解郁的功效（B错）。丁香具有温中降逆，散寒止痛，温肾助阳的功效，为治胃寒呕逆之要药，没有疏肝解郁的功效（D错）。小茴香具有散寒止痛，理气和胃的功效，能暖肝，并善理脾胃之气而开胃、止呕，没有疏肝解郁的功效（E错）。